弥漫性新月体性肾小球肾炎中形成新月体的细胞是
A. 肾小球球囊壁层上皮细胞
B. 肾小球球囊壁层上皮细胞和单核细胞
C. 肾小球球囊脏层上皮细胞和单核细胞
D. 肾小球系膜细胞和内皮细胞
E. 肾小球系膜细胞

正确答案：B。肾小球球囊壁层上皮细胞和单核细胞

解析：新月体由肾小球球囊壁层上皮细胞和单核细胞（B对A错）形成，是弥漫性新月体性肾小球肾炎（急进性肾小球肾炎）的特征性病变。肾小球球囊脏层上皮细胞足突消失是微小病变性肾小球病（P270）的特征性病变。肾小球系膜细胞和内皮细胞（D错）增生是急性弥漫性增生性肾小球肾炎（P265）的特征性病变。